乌梅丸可出现的临床表现是
A. 久泻久痢
B. 渴欲饮冷
C. 赤多白少
D. 里急后重
E. 肛门灼热

正确答案：A。久泻久痢

解析：本题考查乌梅丸的主治。乌梅丸具有温脏安蛔的功效，主治脏寒蛔厥证，其临床表现为脘腹阵痛，烦闷呕吐，时发时止，得食则吐，甚则吐蛔，手足厥冷；或久泻久痢（A对）。渴欲饮冷是里热炽盛的表现（B错）。赤多白少（C错）、里急后重（D错）是热毒血痢的临床表现。肛门灼热是大肠湿热的临床表现（E错）。